有关先天性耳前窦道说法正确的是
A. 多为先天性
B. 第1、2鳃弓发育异常
C. 耳屏前形成皮肤的狭窄盲管
D. 耳屏前形成皮肤的点状凹陷
E. 以上说法均正确

正确答案：E。以上说法均正确

解析：第1鳃沟和第1、2鳃弓发育异常时，可在耳屏前方形成皮肤的狭窄盲管或点状凹陷。此种异常多为先天性，称先天性耳前窦道。掌握“鳃弓与神经嵴”知识点。